反映儿童近期营养状况最灵敏的指标是
A. 头围
B. 身高
C. 坐高
D. 体重
E. 胸围

正确答案：D。体重

解析：本题考查体重的相关内容。体重（D对ABCE错）是反映小儿生长发育的最重要也是最灵敏的指标。因为体重反映儿童的营养状况，尤其是近期的营养状况。体重可以受多种因素的影响如营养、辅食添加、疾病等。身高是反映儿童近期与远期营养状况的重要指标。